葡萄糖由胃肠道进入血液，由血浆进入红细胞再进入神经组织，一系列通过生物膜的方式
A. 简单扩散
B. 滤过
C. 主动转运
D. 载体扩散
E. 胞饮和吞噬

正确答案：D。载体扩散

解析：本题考查化学毒物通过生物膜的方式。葡萄糖由胃肠道进入血液，由血浆进入红细胞再进入神经组织，一系列通过生物膜的方式为载体扩散（D对ABCE错）。